子宫内膜异位症的典型症状是
A. 阴道不规则流血
B. 接触性出血
C. 阴道分泌物增多
D. 继发性痛经
E. 月经量增多

正确答案：D。继发性痛经

解析：子宫内膜异位症典型症状是继发性痛经（D对）、进行性加重。阴道不规则流血（A错）为子宫内膜癌、功能性子宫出血的典型症状。接触性出血（B错）为子宫颈癌的典型症状。阴道分泌物增多（C错）为阴道及盆腔炎症的典型症状。月经量增多（E错）为子宫肌瘤的典型症状。